为减少害虫活动，粮仓温度最少应在
A. 12℃以下
B. 10℃以下
C. 6℃以下
D. 4℃以下
E. 0℃以下

正确答案：B。10℃以下

解析：本题考查可减少害虫活动的粮仓温度。为减少害虫活动，粮仓温度最少应在10℃以下（B对ACDE错）。